为了解人群中某病的患病情况，开展普查工作最适合于
A. 患病率高的疾病
B. 患病率低的疾病
C. 不易发现的隐性疾病
D. 病死率较高的疾病
E. 检查方法操作技术复杂的病种

正确答案：A。患病率高的疾病

解析：本题考查普查的特点。普查即全面调查，是指在特定时点或时期内、特定范围内的全部人群（总体）作为研究对象的调查。为了解人群中某病的患病情况，开展普查工作最适合于患病率高的疾病（A对BCDE错）。